患者，女，68岁。左下牙龈一菜花样溃疡，溃疡约3cm×2cm大小，下唇无麻木，活检诊为“鳞癌Ⅰ级”。下颌部未及明显肿大淋巴结。根据上述症状，该患者应首选的局部检查是
A. CT
B. B超
C. 颌骨X线片
D. 核素骨扫描
E. 穿刺检查

正确答案：C。颌骨X线片

解析：牙龈癌需要做口腔X线检查以确定牙龈癌侵犯的范围，是否有周围组织浸润，需要常规拍摄X线片。掌握“鳞状细胞癌概述及舌癌、牙龈癌”知识点。